患者，女，45岁。2天前感觉胁肋部皮肤灼热疼痛，皮色发红，继则出现簇集性粟粒状大小丘状疱疹，呈带状排列，兼见口苦，心烦，易怒，脉弦数。治疗除取主穴外，还应选用的穴位是
A. 大椎、曲池、合谷
B. 行间、大敦、阳陵泉
C. 血海、隐白、内庭
D. 足三里、阴陵泉、阳陵泉
E. 内庭、曲池、太白

正确答案：B。行间、大敦、阳陵泉

解析：该患者2天前感觉胁肋部皮肤灼热疼痛，皮色发红，继则出现簇集性粟粒状大小丘状疱疹，呈带状排列，故诊断为蛇串疮。口苦，心烦，易怒，脉弦数均为肝火之象，辨为肝经郁火证。大椎、曲池、合谷用于治疗热病（A错）。肝经荥穴行间、井穴大敦、胆经合穴阳陵泉共针能泻肝胆经火毒（B对）。血海、隐白、内庭用于治疗脾胃湿热证（C错）。足三里、阴陵泉、阳陵泉能化湿利水（D错）。内庭能清胃热、化积滞，太白能健脾、和中、涩肠，曲池可用于治疗瘾疹，不能治疗肝经火毒证（E错）。